对下列心力衰竭，地高辛疗效最佳的是
A. 心脏瓣膜病引起的心力衰竭
B. 先天性心脏病引起的心力衰竭
C. 伴有心房扑动、颤动的心力衰竭
D. 甲状腺功能亢进引起的心力衰竭
E. 肺源性心脏病引起的心力衰竭

正确答案：C。伴有心房扑动、颤动的心力衰竭

解析：本题考查地高辛。地高辛通过增强心肌收缩性，使心输出量增加，从而改善动脉系统缺血状况，对伴有心房扑动、颤动的心力衰竭疗效最佳（C对）；对心瓣膜病（A错）、先天性心脏病（B错）引起的心力衰竭效果良好；对甲状腺功能亢进（D错）、肺源性心脏病（E错）引起的心力衰竭疗效较差。